幻觉是指
A. 对客观事物歪曲的知觉
B. 一种虚幻的知觉体验
C. 一种病理基础上产生的病态信念
D. 一种梦幻中的感觉
E. 对事物个别属性的感知障碍

正确答案：B。一种虚幻的知觉体验